随机选择5所幼儿园小班儿童，进行某种新流感疫苗的预防效果观察，随访3年结果表明95%的免疫接种者未患该病，由此研究者认为
A. 该疫苗预防效果好，因可防止95%儿童患病
B. 该疫苗预防效果欠佳，仍有5%的儿童患病
C. 不能下结论，因未进行统计学检验
D. 不能下结论，因未设对照组
E. 不能下结论，因3年观察时间不够

正确答案：D。不能下结论，因未设对照组